关于血浆pH的论述，错误的是
A. 是血液中H+浓度的对数
B. pH<7.35一定有酸中毒
C. pH正常可以表示酸碱平衡正常
D. pH正常可以表示代偿性酸或碱中毒阶段
E. pH正常可以表示混合性酸或碱中毒

正确答案：A。是血液中H+浓度的对数

解析：血浆pH值H+浓度的负对数（A错，为本题正确答案），pH低于7.35为失代偿性酸中毒（B对），pH高于7.45为失代偿性碱中毒。pH值在正常范围内，可以表示酸碱平衡正常（C对），也可表示处于代偿性酸或碱中毒阶段（C对），或同时存在程度相近的混合性酸或碱中毒（E对），使pH变动相互抵消